引起患病率升高的情况不包括
A. 新病例增加（即发病率增高）
B. 治疗水平提高，患者免于死亡，但未痊愈，病程延长
C. 未治愈者的寿命延长
D. 诊断水平提高
E. 病死率增高

正确答案：E。病死率增高

解析：本题考查引起患病率升高的因素。引起患病率升高的主要因素包括：①新病例增加（即发病率增高）（A对）；②治疗水平提高，病人免于死亡，但未痊愈，病程延长（B对）；③未治愈者的寿命延长（C对）；④病例迁入；⑤健康者迁出；⑥易感者迁入；⑦诊断水平提高（D对）；⑧报告率提高。病死率增高（E错，为本题正确答案)是引起患病率降低的因素。